膳食中蛋白质不足导致六氯环已烷、对硫磷毒性增强
A. 实验动物的物种与毒效应
B. 实验动物的品系与毒效应
C. 实验动物的性别与毒效应
D. 实验动物的年龄与毒效应
E. 实验动物的生理营养状况与毒效应

正确答案：E。实验动物的生理营养状况与毒效应